关于髓腔增龄性变化，描述错误的是
A. 髓腔体积随年龄增大而不断缩小
B. 青少年恒牙的髓腔比老年人大
C. 外伤、龋病的刺激加快髓腔缩小
D. 乳牙的髓腔比恒牙相对大
E. 髓室顶、髓角和髓室底随磨耗均不断降低

正确答案：E。髓室顶、髓角和髓室底随磨耗均不断降低

解析：本题考查髓腔的增龄性变化。关于髓腔增龄性变化，描述错误的是髓室顶、髓角和髓室底随磨耗均不断降低（E错，为本题的正确答案）。1.髓腔的形态随年龄的增长不断变化。（1）乳牙的髓腔从相对比例看较恒牙者大（D对），青少年恒牙髓腔比老年者大（B对），表现为髓室大、髓角高、髓室底低平、髓室高度大、根管粗、根尖孔亦大。（2）随年龄的增长，髓腔内壁有继发性牙本质沉积，使髓腔体积逐渐减小（A对），髓角变低，髓室底变突，髓室高度变小，根管变细，根尖孔窄小，有的髓腔部分或全部钙化阻塞。（3）髓室增龄变化的继发性牙本质沉积方式因牙位而不同，上颌前牙继发性牙本质主要沉积在髓室舌侧壁，其次为髓室顶。磨牙主要沉积在髓室底，其次为髓室顶和侧壁。因此，老年人髓室底常为凸起形，而年轻人多为扁平状。2.年龄因素是髓腔变化的最主要因素，除此之外，外源性刺激因素，如龋病、牙体组织的磨损、磨耗腐蚀、外伤，牙齿治疗过程中对牙体组织的切割，治疗用药及材料的作用等，也对髓腔形态有明显影响。在外源性刺激处相对的髓腔壁上可以局限性地形成第三期牙本质，使髓腔局部形态发生改变，髓腔缩小（C对）。